引起病毒性肺炎占首位的病毒是
A. 腺病毒
B. 流感病毒
C. 呼吸道合胞病毒
D. 副流感病毒
E. 肠道病毒

正确答案：C。呼吸道合胞病毒